某女，36岁，咽部干痒，灼热，微痛，有异物感，咳嗽少痰，颧红，潮热，舌质红，苔少，脉细数。应选用的中成药是
A. 清咽利膈丸
B. 玄麦甘桔颗粒
C. 板蓝根颗粒
D. 复方鱼腥草片
E. 利咽解毒颗粒

正确答案：B。玄麦甘桔颗粒

解析：本题考查的是咽喉肿痛的辨证论治。咽部干痒，灼热，微痛，有异物感，咳嗽少痰，颧红，潮热，舌质红，苔少，脉细数。应选用的中成药是玄麦甘桔颗粒（B对）。咽喉肿痛是以咽痛或咽部不适感，或咽部红肿为主要特征的咽喉部疾病。西医学的感冒、扁桃体炎、百日咳、咽喉炎等有咽喉肿痛者均可参考此内容辨证论治。（一）风热外袭证：【症状】咽部疼痛，逐渐加重，吞咽或咳嗽时疼痛加剧，咽部红肿，颌下有臖核；伴见发热恶风，头痛，咳嗽痰黄。舌质红，苔黄，脉浮数。【中成药应用】常用中成药有清咽利膈丸（A错）、金嗓开音丸、复方鱼腥草片（D错）。（二）火毒上攻证：【症状】咽喉疼痛红肿，吞咽困难，咽喉如梗，咽部红肿明显，颌下有臖核、压痛，伴发热，口渴喜饮，头痛剧烈，小便短赤，大便秘结。舌质红，苔黄，脉数有力。【中成药应用】常用中成药有板蓝根颗粒（C错）、六神丸。（三）虚火上炎证：【症状】咽部干燥，微痛，干痒，灼热，有异物感，干咳少痰，或痰中带血；或伴颧红潮热，耳鸣多梦。舌红，苔少，脉细数。【中成药应用】常用中成药有知柏地黄丸、金参润喉合剂、玄麦甘桔含片。中成药应用为利咽解毒颗粒（E错）的病证，2022年考试指南未明确说明。利咽解毒颗粒：【功能】清肺利咽，解毒退热。【主治】用于外感风热所致的咽痛、咽干、喉核红肿、发热恶寒；急性扁桃体炎、急性咽炎见上述证候者。